阳离子交换树脂作为固定相，流动相为
A. 水
B. 甲醇
C. 乙醇
D. 乙酸乙酯
E. 甲醚

正确答案：A。水

解析：本题考查的是离子色谱法。阳离子交换树脂作为固定相，流动相为水（A对）。离子色谱法是根据物质解离程度不同进行分离。离子色谱法也称离子交换法，该法系以离子交换树脂作为固定相，以水或含水溶剂作为流动相。